具有同质多晶型，过热可使其熔点下降而不易成型的栓剂基质是
A. 甘油明胶
B. 聚乙二醇
C. 可可豆脂
D. 半合成山苍子油酯
E. 香果脂

正确答案：C。可可豆脂

解析：本题考查的是栓剂的基质。具有同质多晶型，过热可使其熔点下降而不易成型的栓剂基质是可可豆脂（C对）。栓剂的基质主要分为油脂性和水溶性基质。1.油脂性基质：（1）可可豆脂：常温下为黄白色固体，可塑性好，无刺激性，能与多种药物配伍使用。熔点为31℃～34℃，加热至25℃开始软化，在体温即能迅速融化，10℃～20℃时易粉碎成粉末。可可豆脂具有同质多晶性，有α、β、γ三种晶型。其中通α、γ晶型不稳定，熔点较低，β晶型较稳定，熔点34℃。当加热超过其熔点时，则形成大量的α、γ晶型而使熔点仅为24℃，以致难以成型。（2）半合成脂肪酸甘油酯类：本类基质不易酸败，贮藏中也比较稳定，为目前应用较多的油脂性栓剂基质，其中有半合成椰子油酯、半合成山苍子油酯（D错）、半合成棕榈油酯等。2.水溶性基质：（1）甘油明胶（A错）：系用明胶、甘油与水制成，一般明胶与甘油等量，水应控制在10%以下。具有弹性，不易折断，在体温下能软化并缓慢溶于分泌液中。基质中甘油与水的比例越高则越易溶解，而成品也越软。常用作阴道栓剂基质，但不适用于鞣酸等与蛋白质有配伍禁忌的药物。（2）聚乙二醇（B错）类：聚乙二醇1000、4000、6000的熔点分别为38℃～40℃、53℃～56℃、55℃～63℃，以两种或两种以上的聚乙二醇加热熔融可制得理想硬度和释药速度的栓剂基质。本类基质在体温条件下不熔化，能缓缓溶于直肠液中，但对黏膜有一定刺激性。香果脂（E错），2022年考试指南未明确说明。